男，32岁。发热、头痛伴呕吐2天，意识障碍半天，于8月20日来诊。查体：T39.6℃，P130次/分，R23次/分，BP125/70mmHg，浅昏迷，皮肤未见瘀点，颈抵抗（+），Kernig征（+），Babinski征（+）。实验室检查：血WBC16.0×10⁹/L，N0.73，L0.27。对明确诊断最有价值的检查是
A. 头颅CT
B. 血清特异性IgM
C. 脑脊液培养
D. 隐球菌抗原
E. 血培养

正确答案：B。血清特异性IgM

解析：中年男性，发热、头痛伴呕吐2天，意识障碍半天（流行性乙型脑炎初期症状），于8月20日入院（流行性乙型脑炎夏秋季高发）。查体T39.6℃，P130次/分，R23次/分，BP125/70mmHg。浅昏迷，皮肤未见瘀点，颈抵抗（+），Kernig征（+），Babinski征（+）。（流行性乙型脑炎极期症状）。实验室检查血WBC16.0×10⁹/L（正常参考值4～10×10⁹/L），中性粒细胞0.73（正常参考值0.5～0.7），淋巴细胞0.27（正常参考值值0.2～0.4）。根据患者临床表现及实验室检查，该患者最可能的诊断为流行性乙型脑炎，临床上以高热、意识障碍、抽搐、病理反射及脑膜刺激征为特征，外周血白细胞总数增高，血清特异性IgM抗体（B对）有助于早期确诊。头颅CT（A错）用于结核性脑膜炎诊断。乙脑的病原体存在于脑实质中，血液和脑脊液无法检出，故脑脊液检查（C错）和血培养（E错）无法用于确诊流行性乙型脑炎。隐球菌抗原检测是一种诊断肺隐球菌病的手段（D错）。